含有酰苯胺结构，通过拮抗雌激素受体，用于前列腺癌治疗的药物是
A. 来曲唑
B. 枸橼酸他莫昔芬
C. 氟尿嘧啶
D. 氟他胺
E. 氟康唑

正确答案：D。氟他胺

解析：本题考查氟他胺的结构和药理作用。氟他胺（D对）为非甾体类抗雄激素药物，含有酰苯胺结构，可用于前列腺癌治疗。